酮体包括
A. 草酰乙酸、β-羟丁酸、丙酮
B. 乙酰乙酸、α-羟丁酸、丙酮
C. 乙酰乙酸、γ-羟丁酸、丙酮
D. 乙酰乙酸、β-羟丁酸、丙酮
E. 乙酰丙酸、β-羟丁酸、丙酮

正确答案：D。乙酰乙酸、β-羟丁酸、丙酮

解析：酮体是脂肪酸在肝内进行正常分解代谢时所产生的特殊中间产物，包括乙酰乙酸、β-羟丁酸和丙酮三种物质。酮体是肝内生成肝外利用。掌握“脂肪的分解代谢”知识点。